女，45岁。茶色尿伴腰背痛1个月。查体：贫血貌，巩膜黄染，肝肋下未触及，脾肋下2cm，腹部移动性浊音（-）。血常规：Hb72g/L，WBC6.0×10⁹/L，Plt126×10⁹/L，网织红细胞0.12。Coombs实验（+），Ham（-）。该患者最可能的诊断是
A. 自身免疫性溶血性贫血
B. 巨幼细胞贫血
C. 脾功能亢进
D. 骨髓增生异常综合征
E. 阵发性睡眠性血红蛋白尿

正确答案：A。自身免疫性溶血性贫血

解析：女，45岁（成年女性）。茶色尿伴腰背痛1个月（提示含铁血黄素尿）。查体：贫血貌，巩膜黄染（黄疸表现），肝肋下未触及，脾肋下2cm（脾大），腹部移动性浊音（-）。血常规：Hb72g/L（中度贫血，正常值成年女性＞120g/L），WBC6.0×10⁹/L（正常值4～10×10⁹/L），Plt126×10⁹/L（正常值100～300×10⁹/L），网织红细胞0.12（骨髓红系增生旺盛，正常值0.5%～1.5%）。Coombs实验（+）（温抗体型自身免疫性溶血性贫血最具诊断意义的实验室检查），综上，该患者最可能的诊断是温抗体型自身免疫性溶血性贫血（A对）（P558）。巨幼细胞贫血（B错）少数患者可有黄疸，但无脾大表现，网织红细胞计数可正常（P545）。脾功能亢进（C错）临床表现为脾大，早期以白细胞和（或）血小板减少为主（该患者白细胞及血小板正常，只有血红蛋白降低），晚期常发生全血细胞减少（P603）。骨髓增生异常综合征（D错）血象表现为持续性（≥6月4）一系或多系血细胞减少，如血红蛋白＜110g/L、中性粒细胞小于1.5×10⁹/L、血小板＜100×10⁹/L（P565）。阵发性睡眠性血红蛋白尿（E错）临床主要表现为与睡眠有关、间歇发作的慢性血管内溶血和血红蛋白尿（尿液外观呈酱油色或红葡萄酒样，与该患者茶色尿不符），Ham试验是本病经典的确诊试验（该患者Ham试验阴性）（P560）。